血瘀型产后恶露不绝，宜选用的方剂为
A. 保阴煎
B. 丹栀逍遥散
C. 补中益气汤
D. 生化汤加味
E. 少腹逐瘀汤

正确答案：D。生化汤加味

解析：产后恶露不绝血瘀型，治法活血化瘀止血，用生化汤加味，此方来源于《傅青主女科》功用：化瘀生新，温经止痛，主治：产后瘀血腹痛，恶露不行，小腹冷痛，为妇女产后常用方剂（D对）。产后恶露不绝血热证用保阴煎（A错）。产后恶露不绝血热证若肝郁化热，治宜疏肝解郁，清热凉血（B错）。产后恶露不绝气虚证用补中益气汤（C错）。少腹逐瘀汤不用于治疗产后恶露不尽（E错）。